可用于制备亲水凝胶型骨架片的是
A. 羟丙基甲基纤维素
B. 单硬脂酸甘油酯
C. 大豆磷脂
D. 无毒聚氯乙烯
E. 乙基纤维素

正确答案：A。羟丙基甲基纤维素

解析：本题考查骨架型缓（控）释材料。亲水性凝胶骨架材料可分为4类。①天然胶，如海藻酸盐、琼脂等；②纤维素衍生物，如甲基纤维素（MC）、羧甲基纤维素钠（CMC-Na）、羟丙甲纤维素（HPMC）（A对）、羟乙基纤维素（HEC）等；③非纤维素多糖类，如甲壳素、壳聚糖、卡波姆等；④高分子聚合物，如聚维酮（PVP）、聚乙烯醇（PVA）等。单硬脂酸甘油酯（B错）为溶蚀性骨架材料。大豆磷脂（C错）为制备脂质体的材料。无毒聚氯乙烯（D错）和乙基纤维素（E错）为不溶性骨架材料。